男性患儿，因牙齿咀嚼不适月余前来就诊。查见左下第二乳磨牙牙冠变色，牙龈出现瘘管，轻压溢脓，患牙叩诊反应不明显，仅在咬诊时有不适反应。X线片可见根分歧部分有阴影出现，则可以诊断此病为
A. 乳牙急性根尖周炎
B. 乳牙慢性根尖周炎
C. 乳牙急性牙髓炎
D. 乳牙慢性牙髓炎
E. 乳牙牙本质敏感

正确答案：B。乳牙慢性根尖周炎

解析：本题考查乳牙牙髓病及根尖周病诊断及治疗。乳牙慢性根尖周炎（B对）的临床表现为患牙咀嚼不适，牙龈出现瘘管，反复溢脓，肿胀，牙冠变色，叩诊反应无明显异常或仅有不适，一般不松动，X线片可见根尖部和根分歧处有牙槽骨的破坏的透射影像。